下列描述错误的是
A. 上下颌牙齿除上颌中切牙外，牙根大都向远中弯曲
B. 下颌牙舌侧骨阻力小，拔牙时应从舌侧脱位
C. 上颌牙颊侧骨阻力小，拔牙时应从颊侧脱位
D. 上颌第一恒磨牙三根分叉过大时，应先分根再拔除
E. 牙拔除时主要用摇动力，单个圆根可配合扭转力

正确答案：B。下颌牙舌侧骨阻力小，拔牙时应从舌侧脱位

解析：本题考查各类牙拔除术。下列描述错误的是下颌牙舌侧骨阻力小，拔牙时应从舌侧脱位（B错，为本题的正确答案）。下颌牙1～5唇侧骨板薄，阻力小，拔牙时应从唇侧侧脱位；6两侧骨板均薄，78舌侧骨板薄，阻力小，拔牙时应从舌侧脱位；故下颌牙舌侧骨阻力小，拔牙时可从舌侧脱位的说法是不全面的。上下颌牙齿除上颌中切牙牙根较直外，牙根大都向远中弯曲（A对）。上颌牙颊侧骨板薄，阻力小，拔牙时应从颊侧脱位（C对）。上颌第一恒磨牙三根分叉过大时，先分根可减小根部阻力，便于拔除（D对）。牙拔除时主要用摇动，利用牙槽骨的弹性和让性，将牙槽窝逐渐扩大，并撕裂牙周膜，单个圆根可配合扭转力（E对），会更容易使牙齿脱位。